农业生产中的有害因素是
A. 农药、化肥和有害化学气体
B. 不良气象条件，农机作业的噪声和振动
C. 谷物粉尘
D. 寄生虫、昆虫
E. 以上都是

正确答案：E。以上都是